下列哪种氨基酸中能转化生成儿茶酚胺
A. 天冬氨酸
B. 色氨酸
C. 酪氨酸
D. 脯氨酸
E. 蛋氨酸

正确答案：C。酪氨酸